干性支气管扩张症的主要症状是
A. 反复咳嗽
B. 大量脓痰
C. 反复咯血
D. 营养不良
E. 肌肉酸痛

正确答案：C。反复咯血

解析：在干性支气管扩张的主要症状反复咯血（C对）。部分患者以反复咯血为唯一症状，临床上称为干性支气管扩张，仅以咯血为唯一症状，无咳嗽咳痰，早期也无肺部体征（七版内科学P40）。营养不良（D错）是一个描述健康状况的用语，由不适当或不足饮食所造成。通常指的是起因于摄入不足、吸收不良或过度损耗营养素所造成的营养不足。肌肉酸痛（E错）见于剧烈运动后。反复咳嗽（A错）、大量咳痰（B错），为支气管扩张的典型表现，根据干性支气管扩张的定义可知，均不是干性支气管扩张的主要症状。